偶可致无菌性脑膜炎的非甾体抗炎药是
A. 氟轻松
B. 布洛芬
C. 曲安奈德
D. 布地奈德
E. 倍氯米松

正确答案：B。布洛芬